化学物质的危险度评价不包括
A. 化学物结构分析
B. 危害性认定
C. 剂量-反应关系评价
D. 接触评定和危险度特征分析

正确答案：A。化学物结构分析

解析：本题考查化学物质的危险度评价。化学物质的危险度评价包括：危害性认定（B对）、剂量-反应关系评价（C对）、接触评定和危险度特征分析（D对）。化学物结构分析（A错，为本题正确答案）不属于危险度评价内容。